在研究口服避孕药与子宫内膜癌的前瞻性队列研究中，对对照的选择下列哪项是错误的
A. 男性不能列入对照人群
B. 实验组应为未患该病的人群
C. 对照组应为未患该病的人群
D. 无子宫妇女可纳入对照组
E. 无子宫妇女不可纳入实验组

正确答案：D。无子宫妇女可纳入对照组

解析：本题考查前瞻性队列研究研究对象的选择。选择对照组的基本要求是尽可能保证其与暴露组的可比性，即对照人群除未暴露于所研究的因素外，其他各种影响因素或人群特征都应尽可能地与暴露组相同或相近。因此在本题中，研究为口服避孕药与子宫内膜癌的关系，所以男性不能列入对照人群（A对）；实验组应为未患该病的人群（B对）；对照组应为未患该病的人群（C对）；无子宫妇女不可纳入对照组（D错，为本题正确答案）也不可纳入实验组（E对）。